临证运用健脾丸的辨证要点是
A. 脘腹胀满，嗳腐厌食，苔厚腻，脉滑
B. 脘腹胀满，大便失常，苔黄腻，脉沉有力
C. 脘腹痞闷，食少难消，大便溏薄，苔腻微黄，脉虚弱
D. 心下痞满，食少倦怠，苔腻微黄
E. 眩晕呕吐，胸膈痞闷，食少体倦，小便不利

正确答案：C。脘腹痞闷，食少难消，大便溏薄，苔腻微黄，脉虚弱

解析：健脾丸为治疗脾虚食积证之常用方。方中陈皮、枳实理气化积；山楂、麦芽、神曲消食和胃；人参、白术益气健脾，以助运化。诸药相合，消补兼施，标本同治，脾健食消。故临床以脘腹痞闷，食少难消，大便溏薄，苔腻微黄，脉虚弱为辨证要点（C对）。